男性，56岁，下肢水肿1年，查体，PT11s，APTT56s，体内缺乏的凝血因子为
A. FⅦ
B. FⅤ
C. FⅩ
D. FⅧ
E. FⅡ

正确答案：D。FⅧ

解析：该患者男性，56岁，下肢水肿1年，查体PT正常，APTT时间延长，内源性凝血途径异常，该途径相关的因子是Ⅷ、Ⅸ、Ⅺ、Ⅻ（D对ABCE错）。